女，36岁。既往体健。在春节乘长途汽车回家的路上突然感到心前区发闷、呼吸困难，出汗，觉得自己就要不行了，自己不能控制自己，自己要发疯了。为此感到紧张、害怕。被紧急送到医院急诊，未做特殊处理，半小时后症状消失。患者首先最需要做的辅助检查是
A. ECG
B. 脑CT
C. EEG
D. 胸部X线片
E. 心动超声

正确答案：A。ECG